妇女，54岁。白带增多，均匀稀薄，有臭味，阴道粘膜无明显充血，阴道pH值5。最可能的诊断是
A. 急性淋病
B. 细菌性阴道病
C. 滴虫阴道炎
D. 念珠菌阴道炎
E. 老年性阴道炎

正确答案：B。细菌性阴道病

解析：中年女性患者。白带增多，均匀稀薄（细菌性阴道病分泌物特征），有臭味（细菌性阴道病分泌物常有鱼腥臭味），阴道粘膜无明显充血（细菌性阴道病阴道粘膜无充血等炎症表现），阴道pH值5（细菌性阴道病PH＞4.5）。根据该患者临床表现、体查及实验室检查，最可能的诊断是细菌性阴道病（B对）。急性淋病（A错）主要有阴道脓性分泌物增多，外阴瘙痒或灼热，偶有下腹痛，妇科检查可见宫颈水肿充血等宫颈炎表现，还可引起输卵管炎症、子宫内膜炎、宫外孕和不孕症等。滴虫阴道炎（C错）主要表现为阴道分泌物增多及外阴瘙痒，间或有灼热、疼痛、性交痛等，分泌物典型特点为稀薄脓性、黄绿色、泡沫状、有臭味。老年性阴道炎（E错）又称萎缩性阴道炎，主要表现为外阴灼热不适、瘙痒及阴道分泌物增多，性交痛。